初产妇，28岁。妊娠39周，规律宫缩8小时。血压110/70mmHg，骨盆不小，预测胎儿体重2650g，枕左前位，胎心率正常。肛查宫口开大3cm，S=0。正确处置应为
A. 行人工破膜
B. 不需干涉产程进程
C. 静脉推注地塞米松
D. 静脉滴注缩宫素
E. 胎头吸引术助娩

正确答案：B。不需干涉产程进程

解析：青年初产妇，妊娠39周（妊娠28周及以后为妊娠晚期），血压110/70mmHg（正常值：收缩压90～139mmHg，舒张压60～89mmHg），骨盆不小，胎儿体重2650g（正常胎儿体重为2500～4000g），胎心率正常（正常值110～160次/分），规律宫缩8小时，宫口开大3cm，S=0（说明胎头已衔接），该孕妇处于正常产程，因此不需干涉产程进程（B对），待其自然分娩。行人工破膜（P189）（A错）适用于协调性宫缩乏力，宫口扩张≥3cm、无头盆不称、胎头已衔接而产程延缓者。当妊娠＜34周，1周内有可能分娩的孕妇，可静脉推注地塞米松（P70）（C错）促胎儿肺成熟。静脉滴注缩宫素（P189）（D错）适用于协调性宫缩乏力或使不协调宫缩乏力恢复协调性。胎头吸引术助娩（E错）适用于因妊娠合并心脏病，妊娠高血压综合征，剖宫产史或子宫有瘢痕，不宜用于分娩时屏气者及有轻度胎儿窘迫者。